PKₐ值对弱酸性或弱碱性有机化合物，只有在pH条件适宜，非离子型浓度达到最高才易吸收，发挥毒效应最大
A. 脂/水分配系数与毒效应
B. 电离度与毒效应
C. 挥发度和蒸气压与毒效应
D. 绝对毒性和相对毒性与毒效应
E. 分散度与毒效应

正确答案：B。电离度与毒效应

解析：本题考查电离度与毒效应。PKₐ值对弱酸性或弱碱性有机化合物，只有在pH条件适宜，非离子型浓度达到最高才易吸收，发挥毒效应最大，说明了电离度与毒效应的关系（B对ACDE错）。